含有下列哪项的肥皂会引发光变应性皮炎
A. 香料
B. 四甲基秋兰姆二硫
C. 氯苯胺
D. 羊毛脂
E. 松香

正确答案：C。氯苯胺

解析：本题考查会引发光变应性皮炎的肥皂。肥皂中含有卤素水杨酰替苯胺、氯苯胺（C对ABDE错）会引发光变应性皮炎。